3岁女孩，智能落后，表情呆滞，眼距宽，眼裂小，鼻梁低，舌伸出口外，流涎，皮肤细嫩，肌张力低，通贯手。最可能的诊断是
A. 唐氏综合征（21－三体综合征）
B. 苯丙酮尿症
C. 先天性甲状腺功能减低症
D. 缺钙
E. 软骨发育不良

正确答案：A。唐氏综合征（21－三体综合征）

解析：学龄前儿童，智能落后（唐氏综合征最突出的临床表现），表情呆滞，眼距宽，眼裂小，鼻梁低，舌伸出口外，流涎（以上属于唐氏综合征的特殊面容），皮肤细嫩，肌张力低，通贯手（唐氏综合征特有的皮纹特征），根据患儿的临床症状，考虑该患儿最可能的诊断为唐氏综合征（A对），本病主要特征为智能落后、特殊面容和生长发育迟缓。苯丙酮尿症（B错）虽然也有智能落后，但是患儿头发逐渐由黑变白，皮肤变白，汗液和尿液有明显鼠尿味。先天性甲状腺功能减低症（C错）皮肤粗糙，面色苍黄，常伴有腹胀、便秘、脐疝，且存在黏液水肿。缺钙（D错）及软骨发育不良（E错）不存在智能落后的症状。